女，25岁。进行性全身无力1年余，晨起时无力症状较轻，活动后加重。否认甲亢病史。查体：未见明显的肌肉萎缩及肌张力异常，四肢肌力4级，四肢腱反射正常，肌疲劳试验阳性。最可能的诊断是
A. 周期性瘫痪
B. 急性脊髓炎
C. 多发性肌炎
D. 重症肌无力
E. 吉兰巴雷综合征

正确答案：D。重症肌无力

解析：年轻女性患者，进行性全身无力，晨轻暮重（MG典型表现），肌疲劳试验阳性。最可能的诊断是MG（重症肌无力）（D对）。急性脊髓炎（B错）以病损平面以下肢体瘫痪、传导束性感觉障碍和尿便障碍为特征，急性起病，迅速进展，早期为脊髓休克期，出现肢体瘫痪、肌张力减低、腱反射消失、病理反射阴性（P372）。多发性肌炎（C错）表现为四肢近端肌无力，多伴有肌肉压痛，无晨轻暮重的波动现象（P423）。吉兰巴雷综合征（E错）呈四肢弛缓性瘫痪，远端重于近端，可有周围性感觉障碍和脑神经损害，脑脊液蛋白－细胞分离现象（P400）。